应提倡的医患关系模式是
A. 主动-被动型
B. 指导-合作型
C. 共同参与型
D. 根据具体情况确定
E. 以上都不是

正确答案：D。根据具体情况确定

解析：医患关系模式要以病人的人格特征和疾病的性质为原则来建立，随着病情变化，它不是一成不变的，常常可以由一种模式转向另一种模式。掌握“医患沟通的理论、技术与其应用以及医患关系模式”知识点。